妇女怀孕后，若因胎热导致的胎动不安，治当清热安胎。宜选用的药是
A. 紫苏梗
B. 竹茹
C. 黄芩
D. 黄柏
E. 苎麻根

正确答案：B、C、E。竹茹；黄芩；苎麻根

解析：本题考查的是竹茹、黄芩、苎麻根的功效。妇女怀孕后，若因胎热导致的胎动不安，治当清热安胎。宜选用的药是竹茹（B对）、黄芩（C对）与苎麻根（E对）。竹茹：【功效】清热化痰，除烦止呕，安胎。黄芩：【功效】清热燥湿，泻火解毒，止血，安胎。苎麻根：【功效】凉血止血，清热安胎，利尿，解毒。紫苏梗（A错）为紫苏的梗。紫苏：【功效】发表散寒，行气宽中，安胎，解鱼蟹毒。叶长于发表散寒，梗长于理气宽中，安胎。黄柏（D错）：【功效】清热燥湿，泻火解毒，退虚热。